男，55岁。有饮酒史20年，每日半斤白酒，2年来间断上腹痛，腹胀乏力，大便不成形，双下肢水肿。B超：肝脏回声不均匀增强，脾大，少量腹水。该患者可能的诊断为
A. 慢性胰腺炎
B. 胰腺癌
C. 酒精性肝硬化
D. 慢性胆囊癌
E. 胃癌

正确答案：C。酒精性肝硬化

解析：中年男性患者，饮酒史20年，每日半斤白酒（肝硬化常见病因），2年来间断上腹痛，腹胀乏力，大便不成形（消化不良表现），双下肢水肿（低清蛋白血症表现）。B超：肝脏回声不均匀增强，脾大，少量腹水（肝硬化典型征象），故患者诊断为酒精性肝硬化（C对）。慢性胰腺炎临床上表现为反复发作性或持续性腹痛、腹泻或脂肪泻、消瘦、黄疸、腹部包块和糖尿病（A错）。胰腺癌患者晚期一般表现为明显消瘦、食欲减退、上腹痛、黄疽、上腹部包块（B错）。慢性胆囊癌患者一般表现都有黄疸症状（D错）。胃癌进展期一般表现为体重减轻和上腹痛，且胃镜检查有特征性表现（E错）。